药物信息的特点不包括
A. 政策性强
B. 内容广泛多样
C. 更新传递快速
D. 紧密结合临床
E. 必须去伪存真

正确答案：A。政策性强